某男，28岁。因小便细数就诊。症见小便频数短涩，淋沥刺痛，小腹拘急引痛，其中医诊断是
A. 关精
B. 尿频
C. 淋证
D. 郁证
E. 癃闭

正确答案：C。淋证

解析：本题考查的是淋证。因小便细数就诊。症见小便频数短涩，淋沥刺痛，小腹拘急引痛，其中医诊断是淋证（C对）。淋证是指以小便频数（B错）短涩，淋沥刺痛，小腹拘急引痛为主症的疾病。西医学的泌尿系感染、尿路结石、前列腺炎、尿道综合征等病，具有淋证表现特征者，可参考此内容辨证论治。郁证（D错）是由于情志不舒，气机郁滞所致，以心情抑郁，情绪不宁，胸部满闷，胁肋胀痛，或易怒喜哭，或咽中如有异物梗塞等症为主要临床表现的疾病。西医学的神经衰弱、癔症、抑郁症、焦虑症或抑郁状态以及围绝经期综合征等有上述表现者，可参考此内容辨证论治。癃闭（E错）是以小便量少，排尿困难，甚则小便闭塞不通为主症的疾病。西医学中各种原因引起的尿潴留及无尿症，如神经性尿闭、膀胱括约肌痉挛、尿道结石、尿路肿瘤、尿道损伤、尿道狭窄、前列腺增生症、脊髓炎等病所出现的尿潴留以及肾功能不全引起的少尿、无尿症，可参考此内容辨证论治，但同时还应注意结合辨病求因治疗。关精（A错），2022年考试指南未明确说明。